诸气膹郁，皆属于
A. 肺
B. 肾
C. 心
D. 肝
E. 脾

正确答案：A。肺

解析：“诸气膹郁，皆属于肺”句的意思是多种气逆喘急、胸部胀闷的气机方面的病证，其病机大多属于肺。因肺主气，司呼吸，故气之为病，首责于肺。肺病则宣降失常，气壅郁于胸或上逆，则见呼吸喘急、胸中窒闷、痞塞不通等病证（A对）。诸寒收引，皆属于肾（B错）。诸痛痒疮，皆属于心（C错）。诸风掉眩，皆属于肝（D错）。诸湿肿满，皆属于脾（E错）。